女，25岁。低热，腹痛1个月，尿少，腹围增加1周。查体腹部弥漫压痛（+），呈揉面感，移动性浊音阳性。如考虑腹腔结核感染，对于确诊最有意义的是
A. 腹部X线平片
B. 腹水结核杆菌培养
C. 腹部B型超声检查
D. 胸腹部CT
E. PPD试验

正确答案：B。腹水结核杆菌培养

解析：如该患者考虑腹腔结核感染，对确诊有意义的是腹水结核杆菌培养（B对）。若结核杆菌培养为阳性，则可确诊。腹部X线平片（A错）可见到散在钙化影，腹部B型超声检查（C错）、胸腹部CT（D错）可见增厚的腹膜、腹水、腹腔内包块及瘘管，三者均不能确诊腹腔结核感染。PPD试验（E错）阳性仅表明患者曾感染过结核杆菌，对腹腔结核感染的确诊无特异性。